某男，71岁。体胖，半年来，虚烦、惊悸失眠。证属心肾不交。治当补肾，养心安神，宜选用的药是
A. 麦冬
B. 天冬
C. 玉竹
D. 龙眼肉
E. 莲子肉

正确答案：E。莲子肉

解析：本题考查的是莲子肉的功效。体胖，半年来，虚烦、惊悸失眠。证属心肾不交。治当补肾，养心安神，宜选用的药是莲子肉（E对）。莲子肉：【功效】补脾止泻，益肾固精，止带，养心安神。麦冬（A错）：麦冬：【功效】润肺养阴，益胃生津，清心除烦，润肠通便。天冬（B错）：【功效】滋阴降火，清肺润燥，润肠通便。玉竹（C错）：【功效】滋阴润肺，生津养胃。龙眼肉（D错）：【功效】补心脾，益气血，安心神。